治疗胁痛肝胆湿热证，应首选
A. 龙胆泻肝汤
B. 柴胡疏肝散
C. 旋覆花汤
D. —贯煎
E. 茵陈蒿汤

正确答案：A。龙胆泻肝汤

解析：胁痛肝胆湿热证为湿热蕴结，肝胆失疏，络脉失和所致，治宜清热利湿，首选龙胆泻肝汤（A对）。柴胡疏肝散功能疏肝解郁，理气止痛，为胁痛肝郁气滞证的选方（B错）。旋覆花汤功能理气通阳，活血散瘀，为胁痛瘀血阻络证的选方（C错）。一贯煎功能滋阴柔肝止痛，为胁痛肝络失养证的选方（D错）。茵陈蒿汤功能清热利湿退黄，主治湿热黄疸（E错）。